珍珠具有安神定惊之效，内服入丸散的成人常用剂量为
A. 0.015～0.03g
B. 0.1～0.3g
C. 0.05～0.09g
D. 1.5～2g
E. 3～5g

正确答案：B。0.1～0.3g

解析：本题考查的是珍珠的用法用量。珍珠具有安神定惊之效，内服入丸散的成人常用剂量为0.1～0.3g（B对）。珍珠：【用法用量】内服：研末冲，或入丸散，0.1～0.3g。外用：适量，研末掺，或水飞点眼、吹喉。蟾酥：【用法用量】外用：适量，研末调敷或入膏药。内服：入丸散，0.015～0.03g（A错）。乳香：【用法用量】内服：煎服，3～5g（E错）；或入丸、散，宜炒去油用。外用：适量，研末敷。用量为0.05～0.09g（C错）或1.5～2g（D错）的中药，2022年考试指南未明确说明。